酚妥拉明可用于治疗顽固性充血性心力衰竭的主要原因是其可
A. 兴奋心增强心肌收缩力，使心率加快，心输出量增加
B. 抑制心脏，使其得到休息
C. 扩张肺动脉，减轻右心后负荷
D. 扩张外周小动脉，减轻心脏后负荷
E. 扩张外周小静脉，减轻心脏前负荷

正确答案：D。扩张外周小动脉，减轻心脏后负荷

解析：在心力衰竭时，因心输出量不足，交感张力增加，外周阻力增高，肺充血和肺动脉压力升高，易产生肺水肿，酚妥拉明为α肾上腺素能受体阻滞剂，主要扩张小动脉，减轻心脏后负荷（D对）。左室舒张末期压与肺动脉压下降，心搏出量增加，心力衰竭得以减轻，用于治疗顽固性充血性心力衰竭。酚妥拉明可兴奋心增强心肌收缩力，使心率加快，心输出量增加，但作用较弱，不是治疗顽固性充血性心力衰竭的主要原因（A错）。酚妥拉明主要通过阻断α受体以及对血管的直接舒张作用而使血管扩张，血压下降，反射性兴奋交感神经，同时由于阻断了突触前膜α₂受体，去甲肾上腺素释放增加，心脏兴奋，心率加快，因此不能抑制心脏，使其得到休息（B错）。酚妥拉明主要扩张外周动脉，降低外周阻力，减轻心脏后负荷，对肺动脉作用较弱（C错）。酚妥拉明对静脉容量血管作用较小，不能扩张外周小静脉，减轻心脏前负荷（E错）。